有明显的镇痛作用，可用于肿瘤骨转移所致的高钙血症和痛性骨质疏松症治疗的药物是
A. 雷洛昔芬
B. 阿仑膦酸钠
C. 阿法骨化醇
D. 骨化三醇
E. 降钙素

正确答案：E。降钙素

解析：本题考查药物的作用。降钙素（E对）是参与钙及骨质代谢的一种多肽类激素，具有明显的镇痛作用，对肿瘤骨转移，骨质疏松所致骨痛有明显治疗效果。骨化三醇（D错）是食物或药物（如碳酸钙和葡萄糖酸钙）中的钙在肠道中被主动吸收的调节剂，用于绝经后及老年性骨质疏松。阿法骨化醇（C错）用于佝偻病和软骨病、肾性骨病、骨质疏松症和甲状旁腺功能减退症。雷洛昔芬（A错）是选择性雌激素受体调节剂，用于预防绝经后妇女的骨质疏松症。阿仑膦酸钠（B错）是第三代氨基二膦酸盐类骨代谢调节剂，用于绝经后妇女的骨质疏松症，治疗男性骨质疏松症以预防髋部和脊椎骨折。